薄荷挥发油中含有的主要化学成分的结构类型是
A. 黄酮类
B. 有机酸类
C. 萜类
D. 甾体类
E. 有机胺类

正确答案：C。萜类

解析：本题考查的是薄荷的化学成分。薄荷挥发油中含有的主要化学成分的结构类型是萜类（C对）。薄荷挥发油的化学组成很复杂，油中成分主要是单萜类及其含氧衍生物。薄荷油的质量优劣主要依据其中薄荷醇（薄荷脑）含量的高低而定，《中国药典》以挥发油作为质量控制指标之一，要求其含量不得少于0.8%（ml/g）。同时规定，薄荷脑也作为指标成分，采用气相色谱法测定，含量不得少于0.20%。黄酮类（A错）化合物广泛存在于自然界中，多存在于高等植物及羊齿类植物中。苔类中含有的黄酮类化合物为数不多，而藻类、霉菌、细菌中没有发现黄酮类化合物。含黄酮类化合物的中药有黄芩、葛根、银杏叶、槐花、陈皮、满山红等。有机酸（B错）是一类含羧基的化合物（不包括氨基酸），广泛分布在植物界中，存在于植物的花、叶、茎、果、根等部位，多数与钾、钠、钙等金属离子或生物碱结合成盐的形式存在，也有结合成酯存在的。含有机酸的中药有金银花、当归、丹参、马兜铃等。甾体（D错）类：甾体类化合物是广泛存在于自然界中的一类天然化学成分，包括植物甾醇、胆汁酸、C₂₁甾类、昆虫变态激素、强心苷、甾体皂苷、甾体生物碱、蟾毒配基等。有机胺类（E错）生物碱：结构特点是氮原子不在环状结构内，如麻黄中的麻黄碱，秋水仙中的秋水仙碱，益母草中的益母草碱等。